女，20岁。头晕、乏力1年。实验室检查：Hb70g/L，RBC3.0×10¹²/L，WBC4.1×10⁹/L，PIt200×10⁹/L，血清铁蛋白4μg/L。最可能的诊断是
A. 慢性病性贫血
B. 巨幼细胞贫血
C. 缺铁性贫血
D. 地中海贫血
E. 骨髓增生异常综合征

正确答案：C。缺铁性贫血

解析：患者青年女性，头晕、乏力（贫血表现），红细胞（成年女性正常值3.5～5.0×10¹²／L）、血红蛋白70g／L（成年女性Hb正常值110～150g／L）降低，RBC3.0×10¹²／L（成年女性正常值3.5～5.0×10¹²/L）提示贫血，白细胞4.1×10⁹／L（正常值4～10×10⁹／L），血小板200×10⁹／L（正常值100～300×10⁹／L），白细胞、血小板基本正常，血清铁蛋白4μg／L降低（缺铁性贫血时低于12μg／L），故最可能的诊断是缺铁性贫血（C对）。慢性病性贫血（P543）（A错）多见于老年患者，有慢性炎症、感染、肿瘤等原发疾病的表现，血清铁蛋白常增多；巨幼细胞贫血（P544）（B错）多见于营养不良，维生素B₁₂及叶酸摄入不足；地中海贫血（P543）（D错）有家族史，有溶血表现，血清铁蛋白不低且常增高；骨髓增生异常综合征（P564）（E错）多见于老年人，以血细胞病态造血为主，常表现为全血细胞减少。